为增强收敛止血作用，大蓟宜选用的炮制方法是
A. 扣锅煅炭
B. 米炒
C. 麸炒
D. 炒黄
E. 炒炭

正确答案：E。炒炭

解析：本题考查的是大蓟的炮制方法与炮制作用。为增强收敛止血作用，大蓟宜选用的炮制方法是炒炭（E对）。大蓟：【炮制方法】处方用名有大蓟、大蓟炭。①大蓟：取原药材，除去杂质，抢水洗净，润软，切段，干燥。②大蓟炭：取大蓟段，置炒制容器内，用武火加热，炒至表面焦黑色，内部棕黑色，喷洒少许清水，灭尽火星，取出晾干。【炮制作用】大蓟味苦、甘，性凉。归心、肝经。具有凉血止血，祛瘀消肿的功能。①生大蓟以凉血消肿力胜，常用于热淋，痈肿疮毒及热邪偏盛的出血证。②大蓟炭凉性减弱，收敛止血作用增强。用于吐血、呕血、咯血、嗽血等出血较急剧者。扣锅煅（A错），又称密闭煅、闷煅、暗煅。煅炭的主要目的：①改变药物性能，产生或增强止血作用，如血余炭等。②降低毒性，如干漆等。采用扣锅煅法炮制的中药有血余炭等。米炒（B错）的目的：①增强药物的健脾止泻作用，如党参。②降低药物的毒性，如红娘子、斑蝥。③矫正不良气味，如昆虫类药物。麸炒（C错）的目的：①增强疗效，如山药、白术、芡实等。②缓和药性，如苍术、枳实、薏苡仁等。③矫臭矫味，如僵蚕等。常用炒黄法（D错）炮制的中药有牛蒡子、芥子、王不留行、莱菔子、苍耳子、槐花等。